用于有机磷中毒解救药物的有
A. 阿托品
B. 碘解磷定
C. 氟马西尼
D. 亚甲蓝
E. 硫代硫酸钠

正确答案：A、B。阿托品；碘解磷定

解析：本题考查有机磷中毒解救。有机磷农药中毒最主要的救治原则是清除毒物、特效解毒剂的应用、对症支持治疗,及早洗胃也可以减少毒物的吸收,早期合理应用特效解毒剂,包括阿托品（A对）、氯解磷定、碘解磷定（B对）等。氟马西尼（C错）用于苯二氮䓬类药物中毒解救。亚甲蓝（D错）用于氰化物中毒解救。硫代硫酸钠（E错）用于抢救氰化物中毒，治疗可溶性钡盐（如硝酸钡）、砷、汞、铋、铅等金属中毒。